消毒措施是针对
A. 消除传染源
B. 消除易感者
C. 消除传染源和易感者
D. 消除传染源和传播途径
E. 切断传播途径

正确答案：E。切断传播途径

解析：本题考查消毒措施的意义。消毒是采用化学、物理、生物等方法消除或杀灭外界环境中病原体的一种措施，可分为预防性消毒和疫源地消毒。消毒的目的是为了切断疾病的传播途径（E对ABCD错）。